环境卫生监督的理论依据为
A. 国家和地方政府的相关法律法规
B. 造成人群危害的严重程度
C. 主管部门的行政命令
D. 执法人员的相关知识
E. 环境卫生学研究提供的卫生基准和技术规范

正确答案：E。环境卫生学研究提供的卫生基准和技术规范

解析：本题考查环境卫生监督的理论依据。环境卫生监督的理论依据为环境卫生学研究提供的卫生基准和技术规范（E对ABCD错）。